研究实施者和研究对象不了解分组情况，负责资料收集和分析的人员也不了解分组情况的是
A. 非盲试验
B. 双盲
C. 三盲
D. 单盲
E. 开放性试验

正确答案：C。三盲

解析：本题考查实验流行病学盲法的应用。研究实施者和研究对象不了解分组情况，负责资料收集和分析的人员也不了解分组情况的是三盲（C对ABDE错）。